采用水飞法炮制的中药有
A. 雄黄
B. 朱砂
C. 煅炉甘石
D. 芒硝
E. 石膏

正确答案：A、B。雄黄；朱砂

解析：本题考查的是水飞法。采用水飞法炮制的中药有雄黄（A对）和朱砂（B对）。水飞法：指某些不溶于水的矿物药，利用粗细粉末在水中悬浮性不同，将不溶于水的矿物、贝壳类药物经反复研磨，而分离制备极细腻粉的方法。水飞法的目的：①去除杂质，洁净药物。②使药物质地细腻，便于内服和外用，提高其生物利用度。③防止药物在研磨过程中粉尘飞扬，污染环境。④除去药物中可溶于水的毒性物质，如砷、汞等。常用水飞法炮制的中药有朱砂和雄黄。芒硝（D错）的炮制方法为提静法。提净法：指某些矿物药，特别是一些可溶性无机盐类药物，经过溶解，过滤，除净杂质后，再进行重结晶，以进一步纯净药物的方法。提净的目的：①使药物纯净，提高疗效。②缓和药性。③降低毒性。石膏（E错）与炉甘石（C错）的炮制方法为煅法。煅法：指将药物直接放于无烟炉火中或适当的耐火容器内煅烧的一种方法，称为煅法。依据操作方法和要求的不同，煅法分为明煅法、煅淬法、扣锅煅法（闷煅）。（1）明煅：指药物煅制时，不隔绝空气的方法，又称直火煅法。该法主要适用于矿物类、贝壳类及化石类药物。明煅的主要目的：①使药物质地酥脆，如花蕊石等。②除去结晶水，如白矾、硼砂等。③使药物有效成分易于煎出，如钟乳石、花蕊石等。（2）煅淬：指将药物在高温有氧条件下煅烧至红透后，立即投入规定的液体辅料中骤然冷却的方法。煅后的操作程序称为淬，所用的液体辅料称为淬液。常用的淬液有醋、酒、药汁等，按临床需要而选用。煅淬法适用于质地坚硬，经过高温仍不能疏松的矿物药以及临床上因特殊需要而必须煅淬的药物。煅淬的主要目的：①使药物质地酥脆，易于粉碎，利于有效成分煎出，如赭石、磁石。②改变药物的理化性质，减少副作用，增强疗效，如自然铜。③清除药物中夹杂的杂质，洁净药物，如炉甘石。（3）扣锅煅：指药物在高温缺氧条件下煅烧成炭的方法，又称密闭煅、闷煅、暗煅。适用于煅制质地疏松、炒炭易灰化或有特殊需要及某些中成药在制备过程中需要综合制炭的药物。煅炭的主要目的：①改变药物性能，产生或增强止血作用，如血余炭等。②降低毒性，如干漆等。